属于膨胀性泻药的是
A. 甘油（开塞露）
B. 聚乙二醇4000
C. 乳果糖
D. 酚酞
E. 硫酸镁

正确答案：B。聚乙二醇4000

解析：本题考查泻药。聚乙二醇4000（B对）为膨胀性泻药，在肠内吸收水分后膨胀形成胶体，使肠内容物变软，体积增大，反射性增加肠蠕动而刺激排便。泻药包括容积性泻药、渗透性泻药、刺激性泻药、润滑性泻药、膨胀性泻药、肠道清洗剂及促胃肠动力药。甘油（A错）为润滑性泻药。乳果糖（C错）为渗透性泻药。酚酞（D错）为刺激性泻药。硫酸镁（E错）为容积性泻药。